5岁男孩，突起高热，畏寒3天，伴左膝关节肿痛就诊，查体：左侧膝关节红肿，压痛，活动时疼痛剧烈，浮髌试验（+），下列处理哪项欠佳
A. 局部固定
B. 大剂量静脉注射抗生素
C. 关节内注射抗生素
D. 全身支持疗法
E. 立即切开引流

正确答案：E。立即切开引流

解析：患儿突起高热，畏寒3天，左膝关节剧痛，红肿及压痛，说明为炎症所致，其中浮髌试验阳性提示膝关节积液，故该患儿可诊断为急性化脓性膝关节炎，其治疗包括局部固定（A对）、合理有效的使用抗生素、及时穿刺引流和治疗好转后功能锻炼等。抗生素的应用应早期、足量、联合、敏感，既可全身使用（B对），也可局部并用（C对），以提高血药浓度，改善疗效，但急性炎症期禁忌切开引流（E错，为本题正确答案），以防止炎症播散造成菌血症等，加重病情。